关于能够引起口腔颌面部感染的致病菌，说法不正确的是
A. 常由金黄色葡萄球菌、溶血性链球菌、大肠杆菌等引起
B. 近年来，还可检出厌氧菌，如类杆菌属、梭杆菌属、消化链球菌等
C. 目前口腔颌面部感染最多见的是需氧菌的感染
D. 随着广谱抗生素的广泛应用，耐药菌株引起的感染亦日益增多
E. 口腔颌面部感染可分为化脓性和特异性两大类

正确答案：C。目前口腔颌面部感染最多见的是需氧菌的感染

解析：口腔颌面部感染常由金黄色葡萄球菌、溶血性链球菌、大肠杆菌等引起。近年来，由于应用厌氧培养技术，在口腔颌面部感染中还可检出厌氧菌，如类杆菌属、梭杆菌属、消化链球菌等检出率也极高，说明目前口腔颌面部感染最多见的是需氧菌与厌氧菌的混合感染。随着广谱抗生素的广泛应用，诸如耐甲氧西林金葡菌等耐药菌株引起的感染亦日益增多。因病原菌的不同，口腔颌面部感染可分为化脓性和特异性两大类，后者指结核、梅毒、放线菌等引起的特定病变。掌握“口腔颌面部感染概论”知识点。